牙周袋探诊出血表明
A. 牙周袋内有炎症
B. 根面有残余牙石
C. 需进行牙周翻瓣术
D. 需接受牙龈切除术
E. 需牙周袋内给药

正确答案：A。牙周袋内有炎症

解析：本题考查牙周病的主要症状和临床病理。牙龈是否有炎症，可通过观察牙龈色、形、质的变化和探诊后是否出血来初步判断。牙周袋探针出血，则说明牙周袋内有炎症（A对）。牙周探针探查牙根面不平滑时，则说明根面有残余牙石（B错）。牙周翻瓣术适用于深牙周袋或复杂性牙周袋，经基础治疗后牙周袋仍在5mm以上，且探诊后出血者、不宜做牙周袋切除者、作骨修整或进行植骨者及需直视下进行手术者，单纯牙周袋探诊出血不需进行牙周翻瓣术（C错）。牙龈切除术（D错）适用于牙龈增生经牙周基础治疗后牙龈仍肥大、增生、形态不佳或存在假性牙周袋者、后牙区中等深度骨上袋，袋底不超过膜龈联合，附着龈宽度足够者、牙龈瘤和妨碍进食的妊娠瘤及冠周组织覆盖在阻生牙面上，而该阻生牙的位置基本正常者，单纯牙周袋探诊出血不需接受牙龈切除术。不是所有探诊后出血的患者都需要牙周袋内给药治疗（E错）,以下情况，需要药物补充治疗：全身用抗菌药物作为洁治术和刮治术的补充，可使临床附着水平得到改善；牙周病变存在一些器械不易达到的感染部位；微生物侵入牙周组织；口腔内其他部位的微生物可再定植于牙周袋；巩固疗效、防止复发；牙周组织的急性感染；伴有某些全身性疾病的患者；暂时不能行使口腔卫生措施者。